水生植物可能污染的寄生虫是
A. 蛔虫卵
B. 钩虫
C. 姜片虫囊蚴
D. 绦虫囊尾蚴
E. 旋毛虫包囊

正确答案：C。姜片虫囊蚴

解析：本题考查水生植物可能污染的寄生虫。水生植物，如红菱、茭白、荸荠等有可能污染姜片虫囊蚴（C对ABDE错），生吃可导致姜片虫病。